最易与陈旧性宫外孕相混淆的疾病是
A. 急性阑尾炎
B. 输卵管卵巢囊肿
C. 稽留流产
D. 卵巢黄体破裂
E. 子宫穿孔

正确答案：B。输卵管卵巢囊肿

解析：陈旧性宫外孕（P53）是输卵管妊娠流产或破裂，长期反复内出血形成的盆腔血肿不消散，血肿机化变硬并与周围组织粘连，妇科检查可扪及子宫一侧有不规则肿物；输卵管卵巢囊肿（P324）妇科检查附件区有不规则条形囊性包块，边界不清，活动受限。两者检查体征很相似，故易混淆（B对）。急性阑尾炎（P55）（A错）表现为转移性右下腹疼痛，无囊性包块形成。稽留流产（P49）（C错）表现为停经后阴道流血和腹痛，早孕反应消失，有先兆流产症状或无任何症状，子宫较停经周数小。卵巢黄体破裂（P55）（D错）表现为下腹一侧突发性疼痛，阴道流血无或月经量，可表现为轻度休克。